对正常妇女月经期有影响的是
A. 泻药与雌激素
B. 喹诺酮类抗菌药
C. 四环素类抗生素
D. 氨基糖苷类抗生素
E. 胃动力药

正确答案：A。泻药与雌激素